在苯二氮䓬结构中的4，5位并合四氢噁唑环，得到稳定性更好的前药是
A. 咪达唑仑
B. 奥沙西泮
C. 依替唑仑
D. 奥沙唑仑
E. 艾司唑仑

正确答案：D。奥沙唑仑

解析：本题考查镇静催眠药的结构改造。奥沙唑仑（D对）为前药，是在苯二氮䓬结构中的4，5位并合四氢噁唑环得到的。